主要含有黄酮类化合物的中药有
A. 槐米
B. 川乌
C. 五味子
D. 黄芩
E. 熊胆

正确答案：A、D。槐米；黄芩

解析：本题考查的是含黄酮类化合物的常用中药。主要含有黄酮类化合物的中药有槐花（A对）与黄芩（D对）。含黄酮类化合物的中药有黄芩、葛根、银杏叶、槐花、陈皮、满山红等。川乌（B错）含生物碱类化合物。五味子（C错）含木脂素类化合物。熊胆（E错）含胆汁酸类化合物。